关于牙源性角化囊性瘤的治疗，正确的是
A. 牙源性角化囊性瘤可发生恶变
B. 手术刮除要求彻底
C. 刮除囊壁后硝酸银涂抹骨创
D. 必要时在囊肿外围切除部分骨质
E. 以上均正确

正确答案：E。以上均正确

解析：牙源性角化囊性瘤容易复发，也可发生恶变，因此手术刮除要求更彻底；在刮除囊壁后用苯酚或硝酸银等腐蚀剂涂抹骨创，或加用冷冻疗法，以消灭子囊，防止复发。必要时还可考虑在囊肿外围切除部分骨质。如病变范围太大或多次复发，应考虑将颌骨连同病变的软组织一起切除，立即植骨。掌握“牙源性角化囊性瘤”知识点。